不宜行直肠指诊的疾病是
A. 肛裂
B. 肛窦炎
C. 内痔
D. 肛瘘
E. 肛周脓肿

正确答案：A。肛裂

解析：肛裂（A对）是指肛管皮肤裂伤形成的小溃疡，直肠指诊可使肛门括约肌持续痉挛，增加病人痛苦。肛窦炎（B错）是肛腺感染引起的炎症；内痔（P404）（C错）是肛垫的支持结构、静脉丛及动静脉吻合支发生的病理性改变或移位；肛瘘（P401）（D错）是肛周脓肿经久不愈而形成的肉芽肿性管道；肛周脓肿（P399）（E错）是肛管周围软组织发生急性化脓性感染形成的脓肿，以上疾病均不禁忌直肠指诊。